前牙的根管工作长度是指
A. 牙实际长度
B. 牙根管长度
C. 开髓口到根尖端的长度
D. 切端到根尖狭窄部的长度
E. X片上的牙齿长度

正确答案：D。切端到根尖狭窄部的长度

解析：确定工作长度：①选冠部参照点：选坚实的切端、牙尖或洞缘作为冠部参照点。从参照点到根管的根尖狭窄部，即预定的操作终点之间的距离为工作长度。牙冠部的参考点应该在治疗过程中保持不变，而且容易确认。需要调整咬合的牙齿应先调磨，最好不选充填体或薄弱的牙尖作参考点。掌握“牙髓根尖周病的治疗总论”知识点。